以下哪条神经受损后，对拇指的运动和感觉无影响
A. 正中神经
B. 桡神经浅支
C. 桡神经深支
D. 以上均不对
E. 无

正确答案：C。桡神经深支

解析：正中神经（A错）运动纤维支配第1、2蚓状肌和鱼际肌（拇收肌除外）。感觉纤维则分布于桡侧半手掌、桡侧三个半手指掌面皮肤及其中节和远节指背皮肤。桡神经浅支（B错）分布于手背桡侧半皮肤和桡侧两个半手指近节背面的皮肤。桡神经深支（C错，为本题正确选项）沿途发出分支分布于前臂伸肌群、桡尺远侧关节、腕关节和掌骨间关节，受损后对拇指的运动和感觉无影响。